眶下神经阻滞麻醉口内注射法进针点是
A. 上颌中切牙根尖相应部位的口腔前庭沟顶刺入
B. 上颌侧切牙根尖相应部位的口腔前庭沟顶刺入
C. 上颌尖牙根尖相应部位的口腔前庭沟顶刺入
D. 上颌第一前磨牙根尖相应部位的口腔前庭沟顶刺入
E. 上颌第二前磨牙根尖相应部位的口腔前庭沟顶刺入

正确答案：B。上颌侧切牙根尖相应部位的口腔前庭沟顶刺入

解析：眶下神经阻滞麻醉口内注射法：牵引上唇向前向上，注射针与上颌中线成45°角，于侧切牙根尖相应部位的口腔前庭沟顶刺入，向上后外进针，即可到达眶下孔，但不易进入眶下管。掌握“颌面部常用局麻法及牙拔除的麻醉选择”知识点。